腹膜炎患者应进行手术探查的情况是
A. 体温超过38℃
B. 年龄超过60岁
C. 出现休克症状
D. 发病时间大于6小时
E. 血WBC超过10×10⁹/L

正确答案：C。出现休克症状

解析：腹膜炎患者应进行手术探查的情况有（1）经非手术治疗6-8小时后症状不缓解反而加重，（2）腹腔内原发病严重所致的腹膜炎，（3）腹膜炎较重，出现严重的肠麻痹或中毒症状，尤其是出现休克症状者（C对），（4）腹膜炎病因不明确，且无局限趋势。体温超过38℃（A错）；年龄超过60岁（B错）；发病时间大于6小时（D错）；血WBC超过10×10⁹/L（E错）均可先行非手术治疗。